广泛的颊间隙感染引流切口应该在下颌骨下缘
A. 0.5～1cm
B. 0.3～0.5cm
C. 1～2cm
D. 2～3cm
E. 2.5～3.5cm

正确答案：C。1～2cm

解析：广泛的颊间隙感染则应该从下颌骨下缘以下1～2cm处做平行于下颌骨下缘的切口，从切开的皮下向上潜行钝分离进入颊部脓腔。应注意避免损伤面神经的下颌缘支及面动静脉等。掌握“下颌下间隙、颊间隙感染”知识点。